可根治间日疟和控制疟疾的传播药是
A. 氯喹
B. 奎宁
C. 伯氨喹
D. 乙胺嘧啶
E. 甲氟喹

正确答案：C。伯氨喹

解析：伯氨喹对间日疟和卵形疟在肝脏中的休眠子有较强的杀灭作用，是防治疟疾远期复发的主要药物。掌握“氯喹、青蒿素、伯氨喹及乙胺嘧啶”知识点。